溶原性转换是指
A. 供体菌质粒DNA与受体
B. 细菌染色体的基因发生突变
C. 供菌染色体基因与受菌染色体基因的重组
D. 两种细菌原生质体融合后发生染色体基因的重组
E. 感染细菌后的温和噬菌体以前噬菌体形式与溶原菌的染色体整合，溶原菌的基因型改变及获得新的遗传特征

正确答案：E。感染细菌后的温和噬菌体以前噬菌体形式与溶原菌的染色体整合，溶原菌的基因型改变及获得新的遗传特征

解析：溶原性转换指温和噬菌体感染细菌（称为溶原菌）后，以前噬菌体形式与溶原菌的染色体整合，导致溶原菌的基因型改变及获得新的遗传特征。经过溶原性转换，如白喉棒状杆菌、产气荚膜梭菌和肉毒梭菌等，可分别变为产生白喉毒素、α毒素和肉毒毒素的产毒株。掌握“细菌遗传变异的物质基础及机制”知识点。